Ⅲ型柴胡皂苷具有
A. △l2齐墩果烷结构
B. 138、28一环氧醚键结构
C. 同环双烯结构
D. 异环双烯结构
E. 齐墩果酸结构

正确答案：A。△l2齐墩果烷结构